寒证、实热证的常见脉象是
A. 代脉
B. 涩脉
C. 细脉
D. 弦脉
E. 迟脉

正确答案：E。迟脉

解析：迟脉脉来迟慢，一息不足四至临床多见于寒证，迟而有力为实寒；迟而无力为虚寒。亦见于邪热结聚之实热证（E对）。代脉见于脏气衰微、疼痛、惊恐、跌扑损伤等病证（A错）。涩脉多见于气滞、血瘀和精伤、血少（B错）。细脉多见于气血两虚、湿邪为病（C错）。弦脉多见于肝胆病、疼痛、痰饮等，或为胃气衰败者。亦见于老年健康者（D错）。